一颌面外伤患者，经检查发现外耳道流血性液体，渐转清亮液体。对该病人的处理，哪一项是错误的
A. 用碘纺纱条填塞外耳道
B. 姿势引流
C. 抗炎治疗，预防感染
D. 保持外耳道通畅、干净
E. 先保守治疗

正确答案：A。用碘纺纱条填塞外耳道

解析：本题考查颌面伤伴发危及生命紧急情况急救应注意的问题。颌面外伤患者伴有脑脊液耳漏，处理原则是禁止填塞与冲洗，预防颅内感染（A错，为本题的正确答案）。为避免液体逆流至颅内引发逆行性颅内感染，可进行姿势引流（B对）；辅助使用抗生素（C对）；保持外耳道通畅、干净（D对），防止引流通道阻塞和感染范围扩大；通过保守治疗可促进脑脊液外漏通道早日闭合，避免手术治疗引起继发创伤（E对）。